医疗机构违反规定，涂改伪造隐匿销毁病历资料情节严重的对直接责任人员应
A. 免于行政处分
B. 给予行政处分
C. 酌情给予处理
D. 吊销其执业证书
E. 其善后处理由本人负责

正确答案：D。吊销其执业证书

解析：《医疗事故处理条例》规定，医疗机构或者其他有关机构有下列情形之一的，由卫生行政部令改正，给予警告；对负有责任的主管人员和其他直接责任人员依法给予行政处分或者纪律处分；情节严重的，由原发证部门吊销其执业证书或者资格证书：①承当尸检任务的机构没有正当理由拒绝进行尸检的；②涂改、伪造、隐匿、销毁病历资料的（D对）。